慢性牙髓炎依临床表现可分哪几型
A. 溃疡型、增生型、闭锁型
B. 化脓型、坏死型、液浆型
C. 增生型、坏死型、化脓型
D. 坏死型、坏疽型、溃疡型
E. 浆液型、化脓型、闭锁型

正确答案：A。溃疡型、增生型、闭锁型

解析：本题考查慢性牙髓炎的分类。慢性牙髓炎依临床表现可分为溃疡型、增生型、闭锁型（A对）。慢性闭锁性牙髓炎无明显自发痛，由急性牙髓炎转化而来，有长期的冷热刺激痛史；慢性溃疡性牙髓炎食物嵌塞入洞及冷热刺激产生剧烈疼痛；慢性增生性牙髓炎进食疼痛及进食出血，有红色、蘑菇状牙髓息肉。浆液型和化脓型为急性牙髓炎的分类（BE错）。坏死型属于牙髓变性坏死的分类（CD错），任何一种牙髓炎均无坏疽型的分类（D错）。